糖代谢中与底物水平磷酸化有关的化合物是
A. 3-磷酸甘油醛
B. 3-磷酸甘油酸
C. 6-磷酸葡萄糖酸
D. 1，3-二磷酸甘油酸
E. 2-磷酸甘油酸

正确答案：D。1，3-二磷酸甘油酸

解析：1，3-二磷酸甘油酸转变为3-磷酸甘油酸，生成1分子ATP。这种底物上的高能磷酸键转移给ADP成为ATP的过程称为底物水平的磷酸化作用。掌握“糖分解”知识点。